肠热症发病的第一周，检出伤寒沙门菌最高阳性率的方法是
A. 血培养
B. 尿培养
C. 粪便培养
D. 胆汁培养
E. 呕吐物培养

正确答案：A。血培养

解析：肠热症的标本采集及分离鉴定：根据病程选择采集标本，感染初期，粪检阳性率低，因此发病1周内应取静脉血，第1～3周取骨髓穿刺标本，第2～4周时可取粪便和尿液标本。血液和骨髓液标本应先增菌，然后接种于SS选择性培养基，经37℃培养18～24小时后，挑取无色半透明的菌落，接种至双糖铁半固体培养基鉴别，再做生化反应和血清学凝集试验，进一步鉴定。掌握“志贺氏及沙门氏菌属”知识点。